既破血祛瘀，又消积杀虫的药是
A. 乳香
B. 苏木
C. 姜黄
D. 干漆
E. 王不留行

正确答案：D。干漆